患儿，男，6岁。皱眉眨眼，摇头耸肩，嘴角抽动，时伴异常发声，病情时轻时重。抽动能受意志遏制，可暂时不发作。查脑电图未见异常。其诊断是
A. 习惯性抽搐
B. 多发性抽搐症
C. 癫痫
D. 注意力缺陷多动症
E. 风湿性舞蹈病

正确答案：B。多发性抽搐症

解析：习惯性抽搐多见于4~6岁儿童，往往只有一组肌肉的抽搐，如眨眼、皱眉、龇牙或咳嗽（A错）。多发性抽搐症临床特征为慢性、波动性、多发性运动肌肉快速抽搐，并伴有不自主发声和语言障碍，起病年龄多在2~12岁，抽动能受意志遏制，可暂时不发作，脑电图可正常或非特异性异常（B对）。癫痫是以突然仆倒，昏不识人，口吐涎沫，两目上视，肢体抽搐，惊掣啼叫，喉中发出异常声，片刻即醒，醒后如常人为特征（C错）。注意力缺陷多动症以注意力不集中和动作过多为主要临床特点，但非肌肉不自主抽搐，并且可受到意志的控制（D错）。风湿性舞蹈病多见于6岁以后儿童，女孩居多，是风湿热的主要表现之一，以四肢较大幅度的无目的而不规则的舞蹈样动作为主要表现，生活经常不能自理（E错）。